使声襞缩短、松弛
A. 环甲肌
B. 环杓后肌
C. 环杓侧肌
D. 甲杓肌
E. 杓横肌

正确答案：D。甲杓肌

解析：甲杓肌使声襞缩短、松弛（D对）。